下列哪种研究方法不属于描述性研究
A. 病例报告
B. 横断面研究
C. 病例对照研究
D. 生态学研究
E. 随访研究

正确答案：C。病例对照研究

解析：本题考查描述性研究的分类。描述性研究常见的类型主要有：现况研究、生态学研究（D对）、病例报告（A对）、病例系列分析、个案研究、历史资料分析、随访研究（E对）等。现况研究又被称为横断面研究（B对）。病例对照研究（C错，为本题正确答案）属于分析性研究。